丘脑非特异性投射系统
A. 投射至皮层特定区域，具有点对点关系
B. 投射至皮层，产生特定感觉
C. 投射至皮层广泛区域，提高皮层的兴奋性
D. 被切断时，动物保持清醒状态
E. 受刺激时，动物处于昏睡状态

正确答案：C。投射至皮层广泛区域，提高皮层的兴奋性

解析：丘脑非特异性投射系统经多次换元并弥散性投射到大脑皮层广泛区域，提高皮层的兴奋性（C对），但不具有点对点投射关系（A错），因而不能产生特定感觉（B错）。该系统起维持和改变大脑皮层兴奋状态的作用，因此被切断时，动物处于昏睡状态（D错）；受刺激时，动物保持清醒状态（E错）。